导致视神经炎的抗结核病是
A. 利福平
B. 利福喷丁
C. 乙胺丁醇
D. 吡嗪酰胺
E. 对氨基水杨酸钠

正确答案：C。乙胺丁醇

解析：本题考查乙胺丁醇。导致视神经炎的抗结核病是乙胺丁醇（C对）。乙胺丁醇的主要不良反应为球后视神经炎，表现为弱视、红绿色盲和视野缩小。其发生率随用药剂量的增加而增加，每日15mg/kg的常用量较少发生，而每日剂量为25mg/kg时较易发生。用药期间应定期进行眼科检查，一旦发现立即停药，可自行恢复正常。利福平（A错）不良反应常见有消化道反应、肝毒性、类流感样综合征等。利福喷丁（B错）常见胃肠道反应、皮疹等，偶见头痛、头晕、氨基转移酶升高。吡嗪酰胺（D错）不良反应有常见肝脏损害，如血清转氨酶升高，甚或出现黄疸。对氨基水杨酸（E错）常见胃肠道反应，也可引起皮疹、发热、关节痛、白细胞减少症和肝肾损害等。